关于咬肌间隙感染的叙述中，下列说法错误的是
A. 感染来源主要来自下颌智牙冠周炎及下颌磨牙的根尖周炎
B. 表现为下颌支及下颌角为中心的咬肌区肿胀、充血
C. 伴明显开口受限
D. 偶因化脓性腮腺炎波及
E. 易触到波动感，脓肿易溃破

正确答案：E。易触到波动感，脓肿易溃破

解析：本题考查咬肌间隙感染。关于咬肌间隙感染的叙述中，下列说法错误的是易触到波动感，脓肿易溃破（E错，为本题正确答案）。由于咬肌肥厚坚实，脓肿难以自行溃破，也不易触到波动感。咬肌间隙感染的感染来源：主要来自下颌智齿冠周炎，下颌磨牙的根尖周炎（A对）、牙槽脓肿，亦可因相邻间隙如颞下间隙感染的扩散，偶有因化脓性腮腺炎波及（D对）者。典型症状：是以下颌支及下颌角为中心的咬肌区肿胀、变硬、压痛伴明显开口受限（C对），病患处压力大，可导致充血（B对）。若炎症在一周以下，压痛点局限或有凹陷性水肿，经穿刺有脓液时，应行切开引流，否则由于长期脓液蓄积，易形成下颌骨升支部的边缘性骨髓炎。